病例对照研究中，如某因素的存在可提高其相应疾病的检出率，则可发生
A. 入院率偏倚
B. 奈曼偏倚
C. 检出症候偏倚
D. 无应答偏倚
E. 回忆偏倚

正确答案：C。检出症候偏倚